《医疗机构管理条例》的执业要求中规定，医疗机构执业必须
A. 遵守有关法律、法规
B. 遵守有关法律、法规、规章制度
C. 遵守有关法律、法规、医疗技术规范
D. 遵守有关法律、法规、向患者承诺的公约
E. 遵守有关法律、法规、医疗道德

正确答案：C。遵守有关法律、法规、医疗技术规范

解析：《医疗机构管理条例》中规定，任何单位和个人，未取得《医疗机构执业许可证》，不得开展诊疗活动。医疗机构执业，必须遵守有关法律、法规和医疗技术规范。掌握“医疗机构概述及机构执业”知识点。